无牙颌磨牙后垫是什么区
A. 主承托区
B. 副承托区
C. 缓冲区
D. 封闭区

正确答案：D。封闭区

解析：本题考查无牙颌的功能分区。无牙颌磨牙后垫是封闭区（D对）。磨牙后垫位于下颌牙槽峪远端的黏膜软垫，呈卵圆形，由疏松结缔组织构成，含有黏液腺。磨牙后垫位置稳定，是排列人工牙时确定后牙（牙合）平面和颊舌向位置的参考标志。